我国现行水质标准氟浓度为
A. 0.5ppm
B. 1.0ppm
C. 0.5～1.0ppm
D. 1～2ppm
E. 2ppm

正确答案：C。0.5～1.0ppm

解析：本题考查我国现行水质标准氟浓度。我国现行水质标准氟浓度为0.5～1.0ppm（C对），氟浓度在这一范围内可明显降低龋病的流行。